男孩，5岁。自幼唇指（趾）甲床青紫，乏力，活动后气促，体格发育落后，胸骨左缘第2～3肋间可闻及Ⅲ级收缩期杂音，经超声心动图证实为先天性心脏病，法洛四联症。此患儿突然发生昏厥抽搐最可能并发
A. 支气管肺炎
B. 充血性心力衰竭
C. 低钙惊厥
D. 脑血栓，脑脓肿
E. 癫痫

正确答案：D。脑血栓，脑脓肿

解析：法洛四联症最易引起的并发症是脑血栓、脑脓肿，并且患者突发昏厥抽搐也同样符合并发症脑血栓、脑脓肿的临床表现（D对）。法洛四联症不会并发低钙惊厥（C错）和癫痫（E错）。另外假如法洛四联症并发支气管肺炎（A错）和充血性心力衰竭（B错）不会有昏厥抽搐的临床表现。